药物成盐修饰的作用有
A. 产生较理想的药理作用
B. 调节适当的pH值
C. 有良好的溶解性
D. 降低对机体的刺激性
E. 提高药物脂溶性

正确答案：A、B、C、D。产生较理想的药理作用；调节适当的pH值；有良好的溶解性；降低对机体的刺激性